肾小管性蛋白尿中不会出现的是
A. β₂微球蛋白
B. 视黄醇结合蛋白
C. 溶菌酶
D. 免疫球蛋白G
E. α₁微球蛋白

正确答案：D。免疫球蛋白G

解析：免疫球蛋白G（D错，为本题正确答案）见于肾小球性蛋白尿。β₂微球蛋白（A对）、视黄醇结合蛋白（B对）、溶菌酶（C对）、α₁微球蛋白（E对）均可见于肾小管性蛋白尿。